左乙拉西坦抗癫痫的作用机制为
A. 阻滞钠通道
B. 阻滞钾通道
C. 调节γ-氨基丁酸水平
D. 拮抗谷氨酸受体
E. 促进氯离子内流

正确答案：C。调节γ-氨基丁酸水平

解析：本题考查左乙拉西坦的作用机制。γ-氨基丁酸是一种神经递质，广泛分布于整个中枢神经系统，发挥突触后抑制作用。左乙拉西坦通过调节γ氨基丁酸水平（C对），改善内源性γ-氨基丁酸介导的抑制作用而发挥抗癫痫作用。